我国目前劳动卫生管理常用的手段中未包括的是
A. 权力行政
B. 环境规划
C. 信息交流
D. 政策鼓励
E. 经济惩罚

正确答案：B。环境规划